脾虚泄泻儿童慎用
A. 启脾丸
B. 肥儿宝颗粒
C. 健儿口服液
D. 小儿消食片

正确答案：D。小儿消食片

解析：本题考查小儿消食片的注意事项。脾虚泄泻儿童慎用小儿消食片（D对）。小儿消食片【注意事项】脾胃虚弱，内无积滞者不宜使用。服药期间，忌食辛辣、油腻之品。启脾丸（A错）【注意事项】湿热泄泻者不宜使用。伴感冒发热、表证未解者慎用。服药期间，忌食生冷、油腻、不易消化食物。建立良好饮食习惯，防止偏食。肥儿宝颗粒（B错）【注意事项】1.忌食生冷油腻及不易消化食品。2.婴儿应在医师指导下服用。3.感冒时不宜服用。4.糖尿病患儿禁服。5.对本品过敏者禁用，过敏体质者慎用。胃阴不足者慎用健儿消食口服液（C错）和复方消食茶。龙牡壮骨颗粒（E错）【注意事项】实热证者慎用。服药期间，忌食辛辣、油腻食物。患儿发热期间暂停服用本品。佝偻病合并手足搐搦者，应配合其他治疗。